表示鱼体开始腐败的K值范围是
A. ≤10%
B. ≤20%
C. ≤30%
D. ≥40%
E. ≥60%

正确答案：D。≥40%